患者左下后牙因龋洞一次完成治疗，几天后复诊自述不敢咬合。查：左下6近中邻（牙合）面银汞合金充填好，无高点及悬突，探银汞充填物边缘完好，叩（-），左上6全冠修复。该牙处理为
A. 观察
B. 调（牙合）
C. 去旧充填体，重新银汞充填
D. 去旧充填体，氧化锌丁香油糊剂安抚，症状消失后复合树脂充填
E. 脱敏治疗

正确答案：D。去旧充填体，氧化锌丁香油糊剂安抚，症状消失后复合树脂充填

解析：本题考查充填后疼痛。患者该牙处理为去旧充填体，氧化锌丁香油糊剂安抚，症状消失后复合树脂充填（D对）。根据病例描述，患牙行银汞合金充填后不敢咬合，检查时见充填完好，无高点及悬突，探银汞充填物边缘完好，叩（-），而患牙的对颌牙为全冠修复，故考虑是由患牙与对颌牙的金属全冠接触产生流电作用激惹牙髓而导致的疼痛，处理时应该去除旧充填体，氧化锌丁香油糊剂安抚，症状消失后复合树脂充填（切记，树脂充填不可用氧化锌丁香油垫底）。观察适用于充填术后牙髓激发痛症状较轻，一般可自行缓解者（A错）。该充填物无高点，不需调（牙合）（B错）。去旧充填体，重新银汞充填后患牙咬合面依然为银汞合金，与对颌牙接触时仍会因流电作用而产生疼痛，不能解决问题（C错）。脱敏治疗多用于治疗牙本质敏感（E错）。